小儿水肿，按诊的主要部位是
A. 头颅
B. 胸胁
C. 腹部
D. 皮肤
E. 四肢

正确答案：D。皮肤

解析：水肿是由于体内水液潴留，泛滥肌肤所致，故小儿水肿，按诊的主要部位是皮肤（D对），肌肿胀，按之随手而起，属阳水水肿；肌肤肿胀，按之凹陷难起，属阴水水肿。